肾剖面不可见
A. 肾实质由浅层的肾皮质和深层的肾髓质构成
B. 肾皮质因富含血管而呈红褐色
C. 肾髓质主要由15～20个肾锥体构成
D. 肾锥体尖端圆钝，朝向肾窦，称肾小盏,2~3个肾小盏合成1个肾大盏
E. 肾柱为肾皮质深入肾锥体之间的部分

正确答案：D。肾锥体尖端圆钝，朝向肾窦，称肾小盏,2~3个肾小盏合成1个肾大盏

解析：肾实质由浅层的肾皮质和深层的肾髓质构成（A对），新鲜的肾皮质富含血管，新鲜标本为红褐色（B对）；肾髓质由15~20个底朝皮质、尖向肾窦的肾锥体构成（C对），2 ~3个肾锥体尖端合并成肾乳头，而肾小盏是承接肾乳头尿液的结构（D错，为本题正确答案）。伸入肾锥体之间的肾皮质称肾柱（E对）。